下列哪项不是引起呼吸性酸中毒的原因？
A. 颅脑损伤
B. 重度低钾血症
C. 呼吸道阻塞
D. 低张性缺氧
E. ARDS

正确答案：D。低张性缺氧

解析：引起呼吸性酸中毒的原因不外乎外环境CO2浓度过高，或外呼吸通气障碍而致的CO2 排出受阻，而低张性缺氧（D错，为本题正确答案）的原因为动脉血氧分压降低、血氧含量减少，一般由吸入气氧分压过低或呼吸功能障碍导致，不会引起呼吸性酸中毒。颅脑损伤（A对）抑制呼吸中枢，重度低钾血症（B对）导致呼吸机麻痹，呼吸道阻塞（C对）和ARDS（E对）（急性呼吸窘迫综合征）导致通气功能障碍，这些原因都可以导致CO2排出受阻引起引起呼吸性酸中毒。